关于感染性休克病人应用糖皮质激素的依据与方法，不正确的是
A. 糖皮质激素可以稳定细胞及溶酶体膜，免受内毒素破坏
B. 大剂量糖皮质激素对心脏发挥正性肌力作用
C. 适当应用糖皮质激素可以减少合并症
D. 糖皮质激素应从大剂量开始
E. 要取得疗效至少要使用5天

正确答案：E。要取得疗效至少要使用5天

解析：在感染性休克的治疗中，糖皮质激素可以稳定细胞及溶酶体膜，免受内毒素破坏（A对），缓解全身炎症反应。应从大剂量开始（D对），维持不宜超过48小时（E错，为本题正确答案），否则有发生急性胃粘膜损害和免疫抑制等严重并发症的危险。大剂量糖皮质激素能增强心肌收缩力，增加心排量，对心脏发挥正性肌力作用（B对）。适当应用糖皮质激素可以抑制补体和激肽活化，减少抗原抗体复合物形成，从而减少合并症（C对）。